下列动脉与胃的血液供应无关的是
A. 肝总动脉
B. 胃左动脉
C. 脾动脉
D. 肝固有动脉
E. 肠系膜下动脉

正确答案：E。肠系膜下动脉

解析：肝总动脉（A对）、胃左动脉（B对）、脾动脉（C对）、肝固有动脉（D对）均与胃的血液供应有关。肠系膜下动脉（E错，为本题正确答案）分支分布于降结肠、乙状结肠和直肠上部，与胃的血液供应无关。